某男，67岁，喘促日久，现咳嗽痰多，气急胸闷，苔腻，脉滑，治疗应选用
A. 越婢加半夏汤
B. 苏子降气汤
C. 涤痰汤
D. 平喘固本汤
E. 真武汤合五苓散

正确答案：B。苏子降气汤

解析：中阳不运，积湿成痰，痰浊壅肺，肺气失降，故咳嗽痰多，气急胸闷；苔腻，脉滑，均为痰浊壅肺证之象，治疗需健脾益肺，化痰降气，方药选用苏子降气汤加减（B对）。越婢加半夏汤（A错）可以清肺化痰，降逆平喘，用于治疗痰热郁肺证。涤痰汤（C错）可以涤痰开窍，熄风止痉，用于治疗痰蒙神窍证。平喘固本汤（D错）可以补肺纳肾，降气平喘，用于治疗肺肾两虚证。真武汤合五苓散（E错）可以温肾健脾，化饮利水，用于治疗阳虚水泛证。